男性，45岁。发现肝硬化已5年。3天前与朋友聚餐时出现呕血，鲜红色，量约1000ml.患者出现头晕心慌出冷汗等。经输血补液和应用止血药物治疗后病情好转，血压和心率恢复正常。1天前起出现睡眠障碍。并出现幻听和言语不清。化验检查示：血氨130μg/dl，血糖5.6mmol/L，尿素氮7.2mmol/L。消化道出血的原因最可能是
A. 胃癌
B. 胃溃疡
C. 十二指肠溃疡
D. 食管静脉曲张破裂
E. 胃粘膜病变

正确答案：D。食管静脉曲张破裂

解析：中年男性患者，既往有肝硬化（可形成食管胃底静脉曲张）病史，3天前与朋友聚餐（食管静脉曲张破裂的诱因）时出现消化道大出血（大于500ml）伴头晕、心慌、出冷汗（出血性休克），考虑诊断为食管静脉曲张破裂（D对）。胃癌（A错）多有胃溃疡、慢性胃炎等病史，表现为不规则上腹痛，抑酸药无效；消化性溃疡（P359）（BC错）腹痛呈周期性、季节性与节律性；胃黏膜病变（E错）多表现为少量呕血、黑便及难以纠正的贫血。以上三种疾病出血量少，不会超过500ml。